药品不良反应报告和监测是指药品不良反应的（）的过程
A. 发现
B. 报告
C. 评价
D. 控制
E. 监督

正确答案：B。报告

解析：国家实行药品不良反应报告制度。掌握“药品不良反应概念、报告、处置与法律责任”知识点。